红丝疔的好发部位是
A. 面部
B. 胸腹部
C. 四肢后侧
D. 四肢内测
E. 四肢外侧

正确答案：D。四肢内测

解析：红丝疔是发于四肢，皮肤呈红丝显露，迅速向上走窜的急性感染性疾病，外因是手足部生疔，或足癣糜烂，或有皮肤破损感染毒邪，内有火毒凝聚，以致毒流经脉，向上走窜而继发红丝疔；若火毒走窜，内攻脏腑，可成走黄之证，好发于四肢内侧（D对ABCE错），常有手足部生疔或皮肤破损等病史。